一患者，主诉：右上后牙牙龈肿痛2天。检查：右上6颊侧牙龈卵圆形肿胀，波动感（+），PD：7mm，探袋内溢脓，电活力测正常。最可能的诊断是
A. 急性牙槽脓肿
B. 急性多发性牙周脓肿
C. 逆行性牙髓炎
D. 急性牙周脓肿
E. 根分叉病变

正确答案：D。急性牙周脓肿

解析：本题考查牙周脓肿的临床表现。根据病例描述，患者右上后牙牙龈肿痛2天，检查见右上6颊侧牙龈卵圆形肿胀，波动感（+），PD：7mm，探袋内溢脓，电活力测正常，可知患牙有深牙周袋，牙周有局限性脓肿，牙髓电活力正常，表明牙髓状态正常，则考虑诊断为急性牙周脓肿（D对）。急性牙槽脓肿（A错）一般来源于牙髓病或根尖周感染，多有牙髓活力丧失，脓肿范围较弥散，中心位于龈颊沟附近，一般没有牙周袋，病例中患牙有牙周袋，脓肿局限于牙周袋壁，近牙龈处，牙髓活力正常，故不考虑为急性牙槽脓肿。急性多发性牙周脓肿（B错）为发生于多个牙齿的急性牙周脓肿，常伴有明显的全身症状，病例中脓肿只发生在单颗牙上，也未诉全身症状，故不考虑为急性多发性牙周脓肿。逆行性牙髓炎（C错）是深牙周袋内的细菌通过牙周袋途径感染牙髓，导致牙髓炎症的情况，主要表现为牙髓炎症症状，该病例中患牙并没有明显的牙髓炎症症状，且牙髓活力正常，故不考虑为逆行性牙髓炎。根分叉病变（E错）为牙周炎的病变和破坏波及了多根牙的根分叉区，在根分叉区出现牙周袋、附着丧失和牙槽骨吸收，病例中并无牙周病变波及根分叉区的依据，故不考虑此诊断。